经皮吸收的主要影响因素有
A. 化学物质分子量的大小
B. 化学物质的脂/水分配系数
C. 皮肤充血
D. 皮肤完整性和通透性
E. 以上均是

正确答案：E。以上均是